下列疾病所致的肺动脉高压中，最主要由低氧血症所致的是
A. 肺血栓栓塞
B. 结缔组织病
C. COPD
D. 特发性肺动脉高压
E. 心源性肺水肿

正确答案：C。COPD

解析：肺部病变和（或）低氧所致肺动脉高压的疾病包括：1.慢阻肺（COPD）；2.间质性肺疾病；3.其它限制性与阻塞性通气障碍并存的肺部疾病；4.睡眠呼吸障碍；5.肺泡低通气；长期居住高原环境；肺发育异常。其中，低氧性肺动脉高压最常见病因是慢性阻塞性肺疾病（COPD）（C对）（COPD时，持续气流受限，使肺组织缺氧，释放更多的收缩血管的活性物质，导致肺动脉高压形成）。肺血栓栓塞（A错）（P99）最主要的机制是肺血栓栓塞致肺血管管腔狭窄甚至闭塞，进而导致肺血管阻力增加、肺动脉压力进行性增高所致，最终导致肺动脉高压。结缔组织病（B错）是系统性疾病，由未明多因素机制所致肺动脉高压。特发性肺动脉高压（D错）（P106）是一种不明原因的肺动脉高压，由动脉中层肥厚、向心或偏心性内膜增生及丛状损害和坏死性动脉炎等构成的疾病，与遗传因素、自身免疫及肺血管内皮、平滑肌功能障碍等因素有关。心源性肺水肿（E错）是由循环阻力增加导致的肺动脉高压。其它选项均为肺动脉高压的类型，但不是由低氧血症导致的。